治疗立克次体病的首选药物是
A. 青霉素G
B. 庆大霉素
C. 链霉素
D. 四环素
E. 多黏菌素

正确答案：D。四环素

解析：本题考查抗菌药物的适应症。治疗立克次体病的首选药物是四环素（D对）。四环素是治疗立克次体病的首选药物。青霉素G（A错）是治疗敏感菌的药物。庆大霉素（B错）是治疗肺炎杆菌、大肠杆菌的药物。链霉素（C错）是治疗结核菌素的杆菌感染药物。多黏菌素（E错）治疗铜绿假单胞菌、不动杆菌属的药物。